男性，65岁。陈旧性广泛前壁心肌梗死7年，活动后胸闷、心悸、气短2年，近1周出现夜间阵发性呼吸困难。体检：端坐呼吸，BP160/90mmHg，P120次/分。P₂亢进，心脏各瓣膜区未闻及杂音。双肺底可闻及细湿啰音，双肺散在哮鸣音。腹平软，肝脾肋下未触及，双下肢无水肿。空腹血糖4.2mmol/L。心电图：V₁～V₆导联ST段压低0.05～0.1mV。血清肌钙蛋白正常。该患者暂不宜立即使用
A. 西地兰
B. 卡维地洛
C. 硝普钠
D. 硝酸甘油
E. 速尿

正确答案：B。卡维地洛

解析：患者老年男性，活动后胸闷心悸气短，近1周出现夜间阵发性呼吸困难，端坐呼吸，双肺底可闻及细湿啰音，考虑诊断为急性左心衰竭。卡维地洛（B错，为本题正确答案）为非选择性β受体拮抗剂，抑制心肌收缩功能，严禁应用于急性心衰。西地兰（A对）属于洋地黄类的药物，有增强心肌收缩的作用，常用于急性心衰的治疗。硝普钠（C对）为动、静脉扩张剂，可迅速降低前后负荷，减轻心衰症状。患者心电图结果示：V₁～V₆导联ST段压低0.05～0.1mV。血清肌钙蛋白正常，提示广泛前壁心肌缺血。硝酸甘油（D对）有利于扩张冠状动脉，改善缺血、减轻症状。速尿（呋塞米）（E对）可通过利尿作用，减少体液潴留，还可扩张静脉，减轻肺水肿。